黄体功能不足的体温特点是
A. 基础体温单相，无低温相
B. 基础体温双相，高温相下降缓慢
C. 基础体温双相，低温相短
D. 基础体温双相，高温相短
E. 基础体温单相，无高温相

正确答案：D。基础体温双相，高温相短

解析：黄体功能不足是指月经周期中有卵泡发育及排卵（基础体温双相），但黄体期孕激素分泌不足或黄体过早衰退，导致子宫内膜分泌反应不良和黄体期缩短（高温相短）。，故黄体功能不足的体温特点是基础体温双相，高温相短（D对C错）。基础体温单相，无低温相（A错）说法错误。基础体温双相，高温相下降缓慢（P346）（B错）是子宫内膜不规则脱落的体温特点。基础体温单相，无高温相（P346）（E错）是青春期无排卵性功能失调性子宫出血的体温特点。